组合性牙瘤
A. 基底细胞极性倒置
B. 肿瘤上皮细胞形成玫瑰花样结构
C. 肿瘤组织内可见到淀粉样物质钙化，呈同心圆样沉积
D. 肿瘤内牙釉质、牙本质、牙骨质和牙髓排列如同正常牙
E. 肿瘤内出现广泛的角化

正确答案：D。肿瘤内牙釉质、牙本质、牙骨质和牙髓排列如同正常牙

解析：组合性牙瘤：患者年龄较小，好发于上颌切牙-尖牙区。X线显示形态及数目不一的牙样物堆积在一起。镜下见肿物由许多牙样结构所组成，这些牙样结构虽然不同于正常牙，但牙釉质、牙本质、牙骨质和牙髓的排列如同正常牙的排列方式。掌握“牙瘤”知识点。